下述哪个结构与喉肌活动有关
A. 中央旁小叶前部
B. 内囊后肢
C. 疑核
D. 颈髓前角内侧核
E. 无

正确答案：C。疑核

解析：疑核（C对）中部发出的纤维加入迷走神经，支配喉的环甲肌；下部发出的纤维最终加入迷走神经，支配除环甲肌以外的喉肌。中央旁小叶前部（A错）管理下肢、会阴部运动。经内囊后肢（B错）下行的纤维束主要为皮质脊髓束，管理四肢肌、躯干肌运动。颈髓前角内侧核（D错）管理躯干固有肌运动。